奈曼偏倚是指
A. 诊断怀疑偏倚
B. 入院率偏倚
C. 测量偏倚
D. 现患病例-新发病例偏倚

正确答案：D。现患病例-新发病例偏倚

解析：本题考查奈曼偏倚。奈曼偏倚是指现患病例-新发病例偏倚（D对ABC错），即如果调查对象选自现患病例，即存活病例，特别是病程较长的现患病例，得到的一些暴露信息可能只与存活有关，而未必与该病的发病有关，从而错误地估计这些因素的病因作用；另一种情况是，某病的幸存者由于疾病而改变了原有的一些暴露特征（如生活习惯），当他们被调查时容易误将这些改变了的暴露特征当作疾病前的状况，从而导致这些因素与疾病的关联误差。